心肌串联性增生的主要原因是：
A. 心肌能量代谢障碍
B. 心肌兴奋-收缩耦联障碍
C. 心脏后负荷长期过重
D. 心脏前负荷长期过重
E. 心肌结构破坏

正确答案：D。心脏前负荷长期过重

解析：长期心肌损伤或负荷增加时，心脏通过心室重塑进行代偿。心肌肥大属于心室重塑的一种，包括离心性肥大和向心性肥大。心脏前负荷长期过重（D对）时，舒张期室壁张力持续增加，刺激心肌串联性增生，并最终发生离心性肥大。心肌后负荷长期过重（C错）时，收缩期室壁张力持续增加，刺激心肌并联性增生，并最终发生向心性肥大。心肌能量代谢障碍（A错）、心肌兴奋-收缩耦联障碍（B错）、心肌结构破坏（E错）均属于心功能不全的发生机制，而非心功能不全时机体的代偿机制。